根据《中华人民共和国药品管理法实施条例》，办理药品零售企业许可事项变更的是
A. 国务院药品监督管理部门
B. 省级药品监督管理部门
C. 设区的市级药品监督管理机构
D. 省级卫生行政部门
E. 国家中医药管理局

正确答案：C。设区的市级药品监督管理机构

解析：本题考查药品经营企业管理。根据《中华人民共和国药品管理法实施条例》，办理药品零售企业许可事项变更的是设区的市级药品监督管理机构（C对）。《中华人民共和国药品管理法实施条例》第三章药品经营企业管理第十二条：开办药品零售企业，申办人应当向拟办企业所在地设区的市级药品监督管理机构或者省、自治区、直辖市人民政府药品监督管理部门直接设置的县级药品监督管理机构提出申请。受理申请的药品监督管理机构应当自收到申请之日起30个工作日内，依据国务院药品监督管理部门的规定，结合当地常住人口数量、地域、交通状况和实际需要进行审查，作出是否同意筹建的决定。申办人完成拟办企业筹建后，应当向原审批机构申请验收。原审批机构应当自收到申请之日起15个工作日内，依据《药品管理法》第十五条规定的开办条件组织验收；符合条件的，发给《药品经营许可证》。第十六条：药品经营企业变更《药品经营许可证》许可事项的，应当在许可事项发生变更30日前，向原发证机关申请《药品经营许可证》变更登记；未经批准，不得变更许可事项。原发证机关应当自收到企业申请之日起15个工作日内作出决定。